某学者为探讨某药物对某病的疗效，选取了120例该病患者，随机分为服用该药的治疗组和使用标准疗法的对照组，随访观察时，观察者与患者均不知道两组接受的措施，一个月后，观察疗效，结果治疗组60名患者中有40人有效，对照组60名中有20人有效，经统计学检查，两组差异具有统计学意义。该药物对疾病治疗的有效率为
A. （20/120）×100%=16，7%
B. （40/60）×100%=66.7%
C. [（40+20）/120]×100%=50.0%
D. （20/40）×100%=50.0%
E. （20/60）×100%=33.3%

正确答案：B。（40/60）×100%=66.7%

解析：本题求该药物对疾病治疗的有效率，选取了120例患者作为治疗的总人数，采取了双盲的资料收集方式（研究对象和观察者均不知患者分组情况和治疗措施），即该药物有效率=有效数/治疗总数×100%=66.7%（B对）。